高血压伴消化性溃疡患者不宜选用的药物是
A. 普萘洛尔
B. 利血平
C. 哌唑嗪
D. 卡托普利
E. 氯沙坦

正确答案：B。利血平

解析：本题考查利血平。高血压伴消化性溃疡患者不宜选用的药物是利血平（B对）。消化性溃疡患者在服用利血平的过程中，胃酸会分泌过多，胃酸堆积会腐蚀肠黏膜，进而加重溃疡。普萘洛尔（A错）禁用于支气管哮喘、心源性休克、心脏传导阻滞（二至三度房室传导阻滞）、重度或急性心力衰竭、窦性心动过缓的患者。哌唑嗪（C错）禁用于对哌唑嗪过敏者。卡托普利（D错）为血管紧张素转化酶抑制剂，妊娠期妇女、高钾血症、双侧肾动脉狭窄、动脉狭窄者、有血管神经性水肿史者禁用。氯沙坦（E错）为血管紧张素Ⅱ受体阻断剂，对该类药物过敏者、双侧肾动脉狭窄患者、妊娠及哺乳期妇女禁用。